属于时间分布的是
A. 石棉工人中间皮瘤、肺癌及胃肠癌的发生率高于其他职业人群
B. 水痘、流行性脑脊髓膜炎和流行性感冒等常在大城市发生流行
C. 因诊断水平的提高使患病率升高
D. 流行性乙型脑炎和脊髓灰质炎多为隐性感染
E. 2015年上海市甲型H1N1流感流行在冬春季节

正确答案：E。2015年上海市甲型H1N1流感流行在冬春季节

解析：本题考查疾病的时间分布。疾病的时间分布特征与变化规律包括短期波动、季节性、周期性、长期趋势等几个方面。如2015年上海市甲型H1N1流感流行在冬春季节（E对ABCD错）属于时间分布的季节性现象。